导致趾及足跖屈无力的是
A. 腰4～腰5腰椎间盘突出
B. 腰3～腰4腰椎间盘突出
C. 腰1～腰2腰椎间盘突出
D. 腰2～腰3腰椎间盘突出
E. 腰5～骶1腰椎椎间盘突出

正确答案：E。腰5～骶1腰椎椎间盘突出

解析：腰椎间盘突出部位不同，受累神经不同，病人常出现相应的感觉、肌力及反射异常。腰5～骶1椎间盘突出常常压迫下位神经根即S1神经根受累，表现为外踝附近及足外侧痛、触觉感觉减退，足跖屈障碍，踝反射减弱或消失，故导致趾及足跖屈无力的是腰5～骶1腰椎椎间盘突出（E对）。腰4～腰5腰椎间盘突出（A错）对应L5受累，表现为小腿外侧和足背痛触觉减退，拇趾背伸肌力减弱。腰3～腰4腰椎间盘突出（B错）对应L4受累，表现为内踝感觉减退，足背伸肌肌力减弱。腰1～腰2腰椎间盘突出（C错）对应L2受累，表现为大腿前中部感觉减退，髂腰肌肌力减弱。腰2～腰3腰椎间盘突出（D错）对应L3受累，表现为股骨内髁感觉减退，股四头肌肌力减弱，膝反射减弱或消失。